可因哪个神经受损引起
A. 面神经
B. 动眼神经
C. 三叉神经
D. 滑车神经
E. 无

正确答案：B。动眼神经

解析：动眼神经（B对）中的一般躯体运动纤维支配上睑提肌，若该神经损伤则导致上睑提肌瘫痪，出现眼睑下垂。面神经（A错）损伤会导致面部表情肌瘫痪、泪腺等腺体分泌异常、舌前2/3味觉减退。三叉神经（C错）损伤会导致头面部、口鼻腔感觉传入障碍、咀嚼肌瘫痪。滑车神经（D错）损伤会导致上斜肌瘫痪，眼球向外下活动受限。